男，60岁。发作性右侧肢体无力伴言语不利2天，每次持续20分钟后可自行缓解。既往有高血压史，最可能的诊断是
A. 部分性癫痫
B. 脑栓塞
C. 周期性瘫痪
D. 短暂性脑缺血发作
E. 脑血栓形成

正确答案：D。短暂性脑缺血发作

解析：老年男性患者，既往有高血压史（提示存在脑动脉硬化可能），发作性右侧肢体无力伴言语不利2天，每次持续20分钟后可自行缓解。最可能的诊断是血流动力学改变导致的短暂性脑缺血发作（D对）。短暂性脑缺血发作血流动力学改变是在各种原因（如动脉硬化和动脉炎等）所致的颈内动脉系统或椎-底动脉系统的动脉严重狭窄基础上，血压的急剧波动导致原来靠侧支循环维持的脑区发生的一过性缺血。部分性癫痫（A错）可表现为感觉性发作或动作性发作，多不能自行缓解（P302）。脑栓塞（B错）是指各种栓子随血流进入颅内动脉使血管腔急性闭塞或严重狭窄，引起相应供血区脑组织发生缺血坏死及功能障碍的一组临床综合征，多有脑实质损害症状，不能自行缓解（P184）。周期性瘫痪（C错）是一组以反复发作的骨骼肌迟缓性瘫痪为特征的疾病，与钾代谢异常有关，发作后不能自行缓解（P370）。